刺激性咳嗽，伴气急、痰中带血，支气管解痉药效果欠佳，其诊断是
A. 支气管哮喘
B. 喘息型慢性支气管炎
C. 支气管肺癌
D. 肺炎支原体肺炎
E. 克雷伯杆菌肺炎

正确答案：C。支气管肺癌

解析：支气管肺癌（C对），癌肿在支气管内长大后，可出现刺激性咳嗽，肿块缺血坏死可导致痰中带血，甚至少量咯血。由于肿瘤造成较大支气管不同程度的阻塞，可以出现胸闷、气急等表现，且不能被支气管解痉药缓解。支气管哮喘（A错）常为阵发性发作性哮喘，可用支气管解痉药缓解症状。喘息型慢性支气管炎（B错）病程较长，常表现为咳痰喘，咳白色粘液或泡沫痰，与患者痰中带血的表现不符。肺炎支原体肺炎（D错）好发于儿童和青年，属于间质性肺炎，主要累及肺间质而不累及肺实质，常表现为阵发性刺激性咳嗽，无痰液或少痰液，与该患者痰中带血的表现不符。克雷伯杆菌肺炎（E错）患者痰液常为砖红色胶冻状，与患者痰中带血的表现不符。